下列关于外科引流的相关叙述中，不恰当的是
A. 脓肿切开创口应放置引流物
B. 切口有严重感染，应考虑放置引流
C. 单纯整复手术必须放置引流
D. 未能完全消灭无效腔创口应放置引流
E. 广泛的大手术，术后有渗血、渗液，应放置引流

正确答案：C。单纯整复手术必须放置引流

解析：感染创口如脓肿切开等必须放置引流物，以使腔内脓液得以不断排出；切口有严重感染或手术本身属于污染创口，为防止感染，也应考虑放置引流；无菌创口，特别是单纯整复手术，一般不放置引流。掌握“口外手术打结、缝合及外科引流”知识点。